美国Framingham心血管病队列研究中，男性队列中发现高胆固醇水平者患冠心病的RR＝2.4（P＜0.05），而在病例对照研究中高胆固醇与冠心病之间的OR＝1.16（P＞0.05）。分析发现，差异的原因是冠心病患者诊断后改变了不良的生活习惯。引起两种研究方法结果差异的原因为
A. 检出偏倚
B. 易感性偏倚
C. 奈曼偏倚
D. 伯克森偏倚
E. 排除偏倚

正确答案：C。奈曼偏倚

解析：本题考查奈曼偏倚。本题中的冠心病患者诊断后改变了不良的生活习惯，当他们被调查时容易误将这些改变了的生活习惯当作疾病前的状况，从而导致这些因素与疾病的关联误差，符合奈曼偏倚（C对ABDE错）的特征。